对脑血管具有较强扩张作用的钙离子通道阻滞药是
A. 维拉帕米
B. 硝苯地平
C. 尼莫地平
D. 地尔硫䓬
E. 加洛帕米

正确答案：C。尼莫地平